患儿，5周岁。两周前曾患上感冒，目前不规则发热，易倦，脸色略苍白，查体发现心率增快，心尖部第一心音减弱，并可闻及早搏，心电图检查：P-R间期延长，ST段下移，实验室检查：C-反应蛋白增高。该患儿首选药物是
A. 水杨酸制剂
B. 洋地黄类药物
C. 地塞米松制剂
D. 镇静剂
E. 抗生素

正确答案：C。地塞米松制剂

解析：本题中患儿不难诊断为风湿性心脏炎，因此早期应使用糖皮质激素，如地塞米松制剂（C对）等。有风湿热但没有心脏炎表现的患儿可使用水杨酸制剂（A错）等非甾体抗炎药。风湿热舞蹈病可用苯巴比妥、地西泮等镇静剂（D错）。洋地黄类药物（B错）属于强心苷类药物，不良反映较多。小儿急性风湿热所引起的心力衰竭，应忌用或慎用强心苷类药物。青霉素类抗生素（E错）主要用来清除链球菌感染，以及预后和预防。